患者，女，22岁。月经初潮年龄16岁，痛经6年，每于第1天出现小腹冷痛，喜温喜按，经量少、色暗淡，腰腿酸软，小便清长，舌苔白润，脉沉迟。治疗应首选
A. 温经汤(《妇人大全良方》）
B. 圣愈汤
C. 调肝汤
D. 温经汤(《金匮要略》）
E. 金匮肾气丸

正确答案：D。温经汤(《金匮要略》）

解析：患者小腹冷痛，经量少而色黯淡，质稀薄是由于肾阳虚弱，虚寒内生，冲任、胞宫失煦，虚寒滞血；寒得热化，故喜温；非实寒凝聚，故喜暗；肾阳不足，故腰腿酸软，小便清长；舌苔白润，脉沉迟为虚寒之象。故可诊断为痛经之阳虚内含，治宜温经暖功止痛，方选温经汤(《金匮要略》）（D对）。温经汤（《妇人大全良方》）可以温经散寒调经，用于治疗月经后期实寒证（A错）。圣愈汤可以益气补血止痛，用于痛经气血虚弱证（B错）。调肝汤补肾益精，养血止痛适用于肾气亏损之痛经（C错）。金匮肾气丸温肾补阳，化气行水，用于肾虚水肿，腰膝酸软，小便不利，畏寒肢冷（E错）。